运动神经切断后所支配的肌肉萎缩，是因为失去神经的
A. 传导作用
B. 支持作用
C. 允许作用
D. 营养作用
E. 支配作用

正确答案：D。营养作用

解析：神经的营养性作用是指神经末梢经常释放某些营养性因子，持续地调整所支配组织的内在代谢活动，影响其持久性的结构、生化和生理的变化。神经的营养作用（D对）在正常情况下不易被察觉，但当神经被切断后即可明显表现出来，它所支配的肌肉内糖原合成减慢，蛋白质分解加速，肌肉逐渐萎缩。传导作用（A错）是传导神经纤维之间兴奋，与肌肉萎缩无关。支持作用（B错）主要是胶质细胞（P274）的功能之一，神经被切断后不会受影响。允许作用（P377）（C错）为激素之间的相互作用。